肺胀早期的主要病理因素
A. 血瘀
B. 水饮
C. 痰浊
D. 痰瘀
E. 气滞

正确答案：C。痰浊

解析：久病肺虚，痰浊潴留于肺，肺气随之不能敛降，气还肺间，肺气胀满是肺胀的病根；感受外邪，则会诱发病情发作或加剧。故肺胀主要病理因素是痰浊，外邪是诱因。（C对）（ABDE错）